社区试验
A. 在易感儿童中进行疫苗接种的效果观察
B. 食盐中统一加碘，使整个研究地区的人群食用，来预防地方性甲状腺肿
C. 在医院评价某种新药的疗效
D. 对流脑流行区的儿童进行中草药漱口的预防效果观察
E. 孕妇抽烟对胎儿发有影响的观察

正确答案：B。食盐中统一加碘，使整个研究地区的人群食用，来预防地方性甲状腺肿